男，69岁，动作缓慢、走路前倾小步2年，伴手部震颤。查体：对答切题，面具脸，四肢肌力增高。头颅CT未见明显异常。最可能的诊断是
A. 脊髓血管病
B. 亚急性脊髓联合变性
C. 帕金森病
D. 进行性脊髓萎缩症
E. 脊髓空洞症

正确答案：C。帕金森病

解析：本例患者老年男性，动作缓慢（运动迟缓），走路前倾小步（姿势平衡障碍）2年，伴手部震颤（静止性震颤），查体：对答切题，面具脸，四肢肌力增高（肌强直），头颅CT未见明显异常。诊断为帕金森病（C对）。帕金森病典型特征为静止性震颤、运动迟缓、肌强直和姿势平衡障碍，CT检查无异常。脊髓血管病（A错）表现为脊髓运动、感觉及括约肌功能障碍，无静止性震颤和姿势平衡障碍等表现（P334）。亚急性脊髓联合变性（B错）是由于维生素B₁₂缺乏引起的神经系统变性疾病，其临床表现以脊髓后索和侧索损害出现深感觉缺失、感觉性共济失调及痉挛性瘫痪为主并伴有周围性感觉障碍（P332）。进行性脊髓萎缩症（D错）病变在下运动神经元，表现为肌无力、肌萎缩和肌束震颤等下运动神经元受损体征。脊髓空洞症（E错）表现为典型的痛温觉障碍和深感觉保存的分离性感觉障碍（P330）。